穿心莲内酯是
A. 单萜
B. 二萜
C. 环烯醚萜醇
D. 环烯醚萜苷
E. 裂环环烯醚萜苷

正确答案：B。二萜